患者因后牙有洞要求治疗。查：左下6（牙合）面点隙龋，可卡探针，叩（-），冷测同对照牙，去腐质后达牙本质浅层，该牙处理应为
A. 银汞合金充填
B. 聚羧酸锌水门汀垫底，银汞合金充填
C. 磷酸锌水门汀充填
D. Ca（OH）₂制剂护髓，银汞合金充填
E. 玻璃离子水门汀垫底，银汞合金充填

正确答案：A。银汞合金充填

解析：患者因后牙有洞要求治疗。查：左下6（牙合）面点隙龋，可卡探针，叩（-），冷测同对照牙，去腐质后达牙本质浅层，该牙处理应为银汞合金充填（A对）。根据病例描述，左下6（牙合）面去腐质后达牙本质浅层，可知该牙为中龋，其窝洞为浅的窝洞，用银汞合金充填时，不需垫底，在洞壁涂布洞漆或粘接剂后可直接充填（BE错）。磷酸锌水门汀充填适用于牙体缺损的暂时性和中期充填修复，一般不用于后牙的永久性充填（C错）。Ca（OH）₂制剂，多用于近髓深龋充填时的衬洞材料（D错）。